14岁以下的人口在总人口中所占的百分比是指
A. 老年人口系数
B. 少年人口系数
C. 老龄化指数
D. 总抚养比
E. 老年人口抚养比

正确答案：B。少年人口系数